食管第三个狭窄约平
A. 第8胸椎
B. 第9胸椎
C. 第10胸椎
D. 第11胸椎
E. 第2胸椎

正确答案：C。第10胸椎

解析：第一个狭窄约平第6颈椎体下缘，第二个狭窄约平第4、5胸椎体之间，第三个狭窄约平第10胸椎(C对)。